患者，女，33岁，腰部疼痛，重着而热，暑湿阴雨天气症状加重，活动后或可减轻，身体困重，小便短赤，苔黄腻，脉濡数，治宜选用
A. 右归丸
B. 白虎汤
C. 四妙丸
D. 甘姜苓术汤
E. 身痛逐瘀汤

正确答案：C。四妙丸

解析：题中患者以腰部疼痛为主，诊断为腰痛；重着而热，暑湿阴雨天加重，身体困重，小便短赤，苔黄腻为湿热腰痛。为湿热壅遏，经气不畅，筋脉失舒所致，治宜清热利湿，舒筋止痛，代表方为四妙丸（C对）。右归丸为肾阳虚腰痛代表方（A错）。白虎汤为阳明气分热盛代表方（B错）。甘姜苓术汤为寒湿腰痛代表方（D错）。身痛逐瘀汤为瘀血腰痛代表方（E错）。